以牛的新鲜胆汁作母液制备体外培育牛黄，加入的化合物有
A. 去氧胆酸
B. 甘氨酸
C. 胆酸
D. 复合胆红素钙
E. 植物黄色素

正确答案：A、C、D。去氧胆酸；胆酸；复合胆红素钙

解析：本题考查的是体外培育牛黄的加工。以牛的新鲜胆汁作母液制备体外培育牛黄，加入的化合物有去氧胆酸（A对）、胆酸（C对）与复合胆红素钙（D对）。体外培育牛黄：【来源】以牛科动物牛的新鲜胆汁作母液，加入去氧胆酸胆酸、复合胆红素钙等制成。